油脂污染中最常见的真菌毒素是
A. 赭曲霉毒素
B. 黄曲霉毒素
C. 展青霉素
D. 伏马菌素
E. 串珠镰胞菌毒素

正确答案：B。黄曲霉毒素

解析：本题考查油脂污染中最常见的真菌毒素。油脂污染中最常见的真菌毒素是黄曲霉毒素（B对ACDE错）。